以下关于模型观测的表述中正确的是
A. 观测线是牙冠解剖外形最突点的连线，不随观测方向改变而改变
B. 观测线是牙冠解剖外形最突点的连线，随观测方向改变而改变
C. 观测线是观测杆沿牙冠轴面最突点画出的连线，不随观测方向改变而改变
D. 观测线是观测杆沿牙冠轴面最突点画出的连线，随观测方向改变而改变
E. 观测线是观测杆沿组织表面最突点画出的连线，不随观测方向改变而改变

正确答案：D。观测线是观测杆沿牙冠轴面最突点画出的连线，随观测方向改变而改变

解析：观测线：将模型固定在观测台上，选好就位道后，用带有直边的铅芯沿牙冠轴面最突点所画出的连线，称为观测线，又称导线。掌握“局部义齿类型，肯氏分类及模型观测”知识点。